饮用水卫生标准中的“游离性余氯”属于
A. 感官性状指标
B. 化学指标
C. 毒理学指标
D. 消毒剂指标
E. 放射性指标

正确答案：D。消毒剂指标

解析：本题考查饮用水卫生标准。游离性余氯是以次氯酸、次氯酸根离子或溶解的单质氯形式存在的氯。饮用水卫生标准中的“游离性余氯”属于消毒剂指标（D对ABCE错）。